只可用于产后止血和子宫复原，不宜用于催产和引产的子宫平滑肌兴奋药是
A. 缩宫素
B. 垂体后叶素
C. 麦角生物碱
D. 硫前列酮
E. 地诺前列腺素

正确答案：C。麦角生物碱